主动-被动型的生物医学模式特征是
A. 医生为病人做什么
B. 医生教会病人做什么
C. 医生帮助病人自我恢复
D. 配合病人做什么
E. 告诉病人做什么

正确答案：A。医生为病人做什么

解析：主动-被动型这是一种最常见的单向性的，以生物医学模式为指导思想的医患关系，在现代医学实践中仍普遍存在，其特征为“医生为病人做什么”。掌握“医患沟通的理论、技术与其应用以及医患关系模式”知识点。